（）是局部振动病的特征性表现
A. 肢端溶骨症
B. 震颤
C. 骨质增生
D. 雷诺现象

正确答案：D。雷诺现象

解析：本题考查局部振动病的特征。手臂振动病的典型表现是振动性白指（VWF），又称职业性雷诺（D对ABC错）现象，是诊断本病的重要依据。其发作具有一过性特点。白指常见的部位是示指、中指和无名指的远端指节，严重者可累及近端指节，以至全手指变白。